急性化脓性牙髓炎（牙髓炎晚期），最突出的症状
A. 紧咬牙可缓解
B. 咬合痛明显，不能对颌
C. 不能平卧，直立可缓解
D. 热刺激痛加重，冷水可缓解
E. 阵发性痛加剧，无法缓解

正确答案：D。热刺激痛加重，冷水可缓解

解析：“急性化脓性牙髓炎”的特殊反应是热刺激极敏感。冷刺激可缓解疼痛。掌握“可复性、急慢性牙髓炎”知识点。